化学因素诱发的肿瘤抗原的特点是
A. 特异性高，抗原性强
B. 特异性高，抗原性弱
C. 特异性低，抗原性强
D. 特异性低，抗原性弱
E. 多具有共同性表达

正确答案：B。特异性高，抗原性弱